患者，男，右侧腮腺区反复肿胀3年，腮腺区发胀，口内时有咸味。如需做腮腺造影检查，一般使用的造影剂是
A. 40%泛影葡胺
B. 60%泛影葡胺
C. 20%泛影葡胺
D. 20%碘化油
E. 60%碘化油

正确答案：B。60%泛影葡胺

解析：本题考查慢性阻塞性腮腺炎。目前唾液腺造影术只限于腮腺及下颌下腺。造影剂有两种：油溶性造影剂为40%碘化油，水溶性造影剂为60%泛影葡胺（B对）。